患儿男，7岁。低热伴皮疹2天就诊。查体：精神好，咽部稍充血，躯干皮肤可见散在丘疹、水疱结痂，心肺（﹣），腹软，肝脾未及。最可能的诊断是
A. 麻疹
B. 水痘
C. 风疹
D. 荨麻疹
E. 猩红热

正确答案：B。水痘